通脉四逆汤合参附龙牡汤适用于心力衰竭的哪种证型
A. 心肾阳虚，痰饮上逆
B. 心肺气虚，痰浊中阻
C. 心肾阳虚，水饮泛滥
D. 心肺气虚，血脉瘀阻
E. 心肾阳虚，虚阳外越

正确答案：E。心肾阳虚，虚阳外越

解析：通脉四逆汤合参附龙牡汤可温补心肾之阳，通脉降逆，故可治心肾阳虚，虚阳外越证（E对）。心肾阳虚，痰饮上逆证（A错）治法为温化痰饮，泻肺逐水，方用苓桂术甘汤、葶苈大枣泻肺汤合保元汤、丹参饮加减。心肺气虚，痰浊中阻证（B错），治法为养心益肺，温化痰饮。心肾阳虚，水饮泛滥（C错）治法为温阳利水，方药用参附汤、五苓散合葶苈大枣泻肺汤、丹参饮加减。心肺气虚，血脉瘀阻（D错）治法为养心补肺，益气活血，方药用保元汤合桃红饮加减，若饮停咳喘者，合用葶苈大枣泻肺汤。